《药品管理法实施条例》，关于定点经营正确地是
A. 全国批发企业可以经营麻醉药品的原料药
B. 区域批发企业可以经营一类精神药品原料药
C. 全国批发企业和区域批发企业都可经营第二类精神药品的批发
D. 区域批发企业可直接从定点生产企业购进麻醉药品
E. 区域批发企业可经省药品监督管理部门批准跨省销售麻醉药品

正确答案：C。全国批发企业和区域批发企业都可经营第二类精神药品的批发

解析：本题考查麻醉药品和精神药品定点生产和销售渠道限制。《药品管理法实施条例》，关于定点经营正确地是全国批发企业和区域批发企业都可经营第二类精神药品的批发（C对）。定点生产和销售渠道限制：1.为严格麻醉药品和精神药品生产管理，国家对麻醉药品和精神药品实行定点生产制度。国务院药品监督管理部门按照合理布局、总量控制的原则，根据麻醉药品和精神药品的需求总量，确定麻醉药品和精神药品定点生产企业的数量和布局，并根据年度需求总量对定点生产企业的数量和布局进行调整、公布。2.定点生产企业的必备条件以及定点生产资格的审批规定，见《麻醉药品和精神药品管理条例》《麻醉药品和精神药品生产管理办法（试行）》原文的具体条款。根据2016年2月《国务院关于修改部分行政法规的决定》（国务院令第666号），麻醉药品、精神药品生产，由省级食品药品监督管理部门审批。3.定点生产企业应当严格按照麻醉药品和精神药品年度生产计划安排生产，并依照规定向所在地省级药品监督管理部门报告生产情况。经批准定点生产的麻醉药品、精神药品不得委托加工。4.定点生产企业生产的麻醉药品和第一类精神药品原料药只能按照计划销售给制剂生产企业和经批准购用的其他单位（AB错），小包装原料药可以销售给全国性批发企业和区域性批发企业。定点生产企业只能将麻醉药品和第一类精神药品制剂销售给全国性批发企业、区域性批发企业以及经批准购用的其他单位（D错）。5.定点生产企业只能将第二类精神药品原料药销售给全国性批发企业、区域性批发企业、专门从事第二类精神药品批发业务的企业、第二类精神药品制剂生产企业以及经备案的其他需用第二类精神药品原料药的企业。生产企业将第二类精神药品原料药销售给制剂生产企业以及经备案的其他需用第二类精神药品原料药的企业时，应当按照备案的需用计划销售。定点生产企业只能将第二类精神药品制剂销售给全国性批发企业、区域性批发企业、专门从事第二类精神药品批发业务的企业、第二类精神药品零售连锁企业、医疗机构或经批准购用的其他单位。6.麻醉药品和精神药品定点生产企业销售麻醉药品和精神药品不得使用现金交易。跨省、自治区、直辖市从事麻醉药品和第一类精神药品批发业务的药品经营企业称为全国性批发企业（E错），应当经国务院药品监督管理部门批准，并予以公布。国务院药品监督管理部门在批准全国性批发企业时，应当明确其所承担供药责任的区域。